罂粟壳的功效是
A. 敛肺涩肠
B. 益肾固精
C. 温中行气
D. 敛疮生肌
E. 清热燥湿

正确答案：A。敛肺涩肠

解析：本题考查罂粟壳的功效。罂粟壳的功效是敛肺涩肠（A对）。罂粟壳【功效】敛肺，涩肠，止痛。莲子肉【功效】补脾止泻，益肾固精（B错），止带，养心安神。肉豆蔻【功效】涩肠止泻，温中行气（C错）。赤石脂【功效】涩肠止泻，止血，止带；外用收湿敛疮生肌（D错）。黄芩【功效】清热燥湿（E错），泻火解毒，止血，安胎。